肝素的抗凝作用特点是
A. 仅在体内有效
B. 仅在体外有效
C. 体内、体外均有效
D. 必须有维生素K的辅助
E. 口服有效

正确答案：C。体内、体外均有效